某女，25岁。既患血热、血瘀痛经，又患痹证关节疼痛，宜选用的药是
A. 茜草
B. 仙鹤草
C. 艾叶
D. 三七
E. 槐花

正确答案：A。茜草

解析：本题考查的是茜草的主治病证。某女，25岁。既患血热血瘀痛经，又患痹证关节疼痛，宜选用的药是茜草（A对）。茜草：【主治病证】（1）吐血，衄血，崩漏，尿血，便血等。（2）闭经，痛经，跌打肿痛，痹证关节痛。仙鹤草（B错）：【主治病证】（1）咳血，衄血，吐血，尿血，便血，崩漏。（2）久泻，久痢。（3）疟疾，痈肿疮毒。（4）滴虫阴道炎所致的阴痒、带下。（5）脱力劳伤。艾叶（C错）：【主治病证】（1）虚寒性崩漏下血、胎漏。（2）经寒痛经、月经不调，带下清稀，宫冷不孕。（3）脘腹冷痛。（4）湿疹瘙痒（外用）。此外，可用于温灸。三七（D错）：【主治病证】（1）咳血，吐血，衄血，便血，崩漏，外伤出血。（2）跌打损伤，瘀滞肿痛。（3）胸腹刺痛。槐花（E错）：【主治病证】（1）血热妄行所致的各种出血证，尤宜便血、痔疮出血。（2）肝火上炎之头痛目赤。